在分析流行病学研究中，下列哪项是暴露的最确切含义
A. 暴露是指一个发病因素
B. 暴露是指多个危险因素
C. 暴露是指研究对象具有某种疑为与患病可能有关的特征，或曾受到某种疑为与患病可能有关的因子的影响
D. 暴露是指接触了危险因素
E. 暴露是指感染了病原体

正确答案：C。暴露是指研究对象具有某种疑为与患病可能有关的特征，或曾受到某种疑为与患病可能有关的因子的影响

解析：本题考查暴露的概念。暴露是指研究对象接触过某种待研究的物质或具有某种待研究的特征（如年龄、性别及遗传性状等）或行为（C对ABDE错）。同时，暴露一定是本研究需要探讨的因素，是与特定的研究目的密切相关的。